苯可引起的法定职业肿瘤为
A. 肝癌
B. 肺癌
C. 胰腺癌
D. 白血病
E. 间皮瘤

正确答案：D。白血病

解析：本题考查苯的致癌种类。苯引起白血病（D对ABCE错）多见于长期、高浓度接触作业者。因为慢性苯中毒对骨髓的影响首先是刺激骨髓细胞增殖，然后抑制细胞分裂，引起核型异常或多倍体，最终发展为白血病。即可先形成再生障碍性贫血、骨髓增生异常综合征后发展为白血病。